护牙托的作用
A. 保护牙齿和口内其他组织
B. 防止颌骨骨折
C. 降低脑震荡发生的可能
D. 增强运动员安全感
E. 以上均对

正确答案：E。以上均对

解析：本题考查牙外伤的预防。护牙托的作用保护牙齿和口内其他组织、防止颌骨骨折、降低脑震荡发生的可能、增强运动员安全感，所以以上均对（E对）。护牙托的作用是：①保护牙齿和口内其他组织（A对），如牙龈、颊和唇；②防止颌骨骨折（B对），特别是保护颞下颌关节；③预防外力对颅脑的冲击伤害，降低脑震荡发生的可能（C对）；④增强运动员的安全感（D对）。护牙托还可以根据不同的防护类型适当调整厚度，提高舒适度，但前牙区唇侧牙托厚度需达3～4mm，第一磨牙区颊侧及咬合面的厚度至少达到2～3mm。